金瓷冠舌侧龈边缘最好为
A. 1mm肩台
B. O．5mm凹形
C. 刃状
D. 凿状
E. 以上都不是

正确答案：B。O．5mm凹形

解析：本题考查修复体龈边缘外形的选择应用。金瓷冠的舌侧边缘是0.5mm的凹形肩台（B对）预备。刃状（C错）、凿状（D错）（即斜面）肩台太窄，不足以容纳金属基底和烤瓷的空间。0.5mm的凹形肩台已经足够满足金瓷冠舌侧龈边缘的要求，无需磨除过多牙体组织制备1mm肩台（A错），违背了尽可能少磨除牙体组织的生物学原则。